下列偏倚中，现况研究中一般不会有
A. 幸存者偏倚
B. 回忆偏倚
C. 无应答偏倚
D. 混杂偏倚
E. 失访偏倚

正确答案：E。失访偏倚

解析：本题考查现况研究常见偏倚。现况研究常见偏倚包括：①无应答偏倚（C对）；②幸存者偏倚（A对）；③报告偏倚；④回忆偏倚（B对）；⑤调查偏倚；⑥测量偏倚；⑦混杂偏倚（D对）。失访偏倚（E错，为本题正确答案）属于队列研究中特有的偏倚